夜盲症需要补充
A. 维生素B₁₂
B. 维生素B₁
C. 维生素B₆
D. 维生素A
E. 维生素D

正确答案：D。维生素A

解析：本题考查维生素A适应症。维生素A（D对）用于防治维生素A缺乏症，如角膜软化、干眼症、夜盲症、皮肤角质粗糙等。